锰中毒是由于
A. 抑制线粒体内三磷酸腺苷酶，使突触线粒体受损
B. 具有高度弥散性和脂溶性，易于通过肺泡壁吸收
C. 对血红素合成酶的抑制
D. 能形成高铁血红蛋白，造成机体各组织缺氧
E. 以上都不是

正确答案：A。抑制线粒体内三磷酸腺苷酶，使突触线粒体受损